基本病变为釉质基质沉积量减少，已形成的基质矿化正常，X线检查釉质与其下方的牙本质有良好的反差属于以下哪种分类
A. 釉质形成不全
B. 釉质成熟不全
C. 釉质钙化不全
D. 遗传性乳光牙本质
E. 畸形中央尖

正确答案：A。釉质形成不全

解析：形成不全型：基本病变为釉质基质沉积量减少，已形成的基质矿化正常，X线检查釉质与其下方的牙本质有良好的反差。掌握“釉质形成缺陷（釉质发育不全）”知识点。